某医师治初产妇乳肿痛最喜用蒲公英，此因蒲公英清热解毒外，又能
A. 活血
B. 凉血
C. 通络
D. 化痰
E. 通乳

正确答案：E。通乳

解析：本题考查的是蒲公英的性能特点。某医师治初产妇乳肿痛最喜用蒲公英，此因蒲公英清热解毒外，又能通乳（E对）。蒲公英：【性能特点】本品苦寒清泄，甘淡渗利，入肝、胃经。药食兼用，既善清热解毒，又兼疏肝通乳、散结消痈，还能利尿、缓通大便，导湿热、热毒从二便而出。力强效佳而味不甚苦，为治疮肿良药。虽内、外痈皆宜，但以外痈为主，乳痈尤佳，内服外用皆效，并治火毒咽痛、目赤及湿热黄疸、淋痛。【功效】清热解毒，消痈散结，利湿通淋。大血藤：【功效】清热解毒，活血（A错）止痛，祛风通络（C错）。大青叶：【功效】清热解毒，凉血（B错）消斑，利咽消肿。牛黄：【功效】清热解毒，息风止痉，化痰（E错）开窍。